以下不属于多发性基底细胞痣综合征的临床表现的是
A. 多发性角化囊肿
B. 皮肤基底细胞痣
C. 分叉肋
D. 大脑镰钙化
E. 骨纤维异常增生

正确答案：E。骨纤维异常增生

解析：本题考查多发性基底细胞痣综合征的临床表现。以下不属于多发性基底细胞痣综合征的临床表现的是骨纤维异常增生（E错，为本题正确答案）。多发性角化囊肿（A对）同时伴发皮肤基底细胞痣（B对）（或基底细胞癌），分叉肋（C对）、眶距增宽、颅骨异常、大脑镰钙化（D对）等症状时，称为“痣样基底细胞癌综合征”或“多发性基底细胞痣综合征”。